健康婴儿，前囟约1.5cm，未出牙，身长60cm，体重6kg，能笑出声，不能辨认熟人和陌生人，不能独坐，最可能的月龄是
A. 6个月
B. 4个月
C. 8个月
D. 10个月
E. 2个月

正确答案：B。4个月

解析：婴儿不能独坐，排除ACD。能笑出声，最可能的月龄是4个月（B对）。出生时体重约为3.25kg，生后3～4个月体重约等于出生时体重的2倍。